麻疹确诊的依据是
A. 发热伴上呼吸道卡他症状
B. 流行季节，有麻疹的接触史
C. 病程5天血清抗麻疹抗体阳性
D. 血白细胞数减少
E. 眼、鼻分泌物测定麻疹抗原阳性

正确答案：E。眼、鼻分泌物测定麻疹抗原阳性